碘缺乏病的论述中，错误的是
A. 碘缺乏病是一种世界性的地方病
B. 女性患病率一般高于男性
C. 该病的流行与自然地理因素密切相关
D. 平原高于山区
E. 内陆高于沿海

正确答案：D。平原高于山区

解析：本题考查碘缺乏病。碘缺乏病是指从胚胎发育至成人期由于碘摄入量不足而引起的一系列病症，是一种世界性的地方病（A对）。碘缺乏病病区地理分布特点是山区高于平原（D错，为本题正确答案），内陆高于沿海（E对），农村高于城市。碘缺乏病女性患病率一般高于男性（B对），但在严重流行地区，男女患病率差别不明显。环境中碘的水平受地形、气候、土壤、水文、植被等因素的影响，所以碘缺乏病的流行与自然地理因素有着极其密切的关系（C对），容易造成远离海洋、山高坡陡、土地贫瘠、植被稀少、降雨集中和水土流失等。